假设演绎法中，推出的经验证据成立，则
A. 假设可能成立
B. 假设必定成立
C. 假设尚不能成立
D. 假设本身难以推论
E. 假设尚待更多证据

正确答案：A。假设可能成立

解析：本题考查假设演绎法。假说演绎法是指在观察和分析基础上提出问题以后，通过推理和想象提出解释问题的假说，根据假说进行演绎推理，再通过实验检验演绎推理的结论。如果推出的经验证据成立，则假设可能成立（A对BCDE错）。